某地区有10万人口，1960年总死亡人数1000名，已发现的结核病患者有300名，男性200名，女性有100名，1960年有60名死于结核病，其中50名为男性，男性结核病死亡率为
A. 0.2
B. 0.25
C. 0.3
D. 0.5
E. 所给资料不能计算

正确答案：E。所给资料不能计算

解析：本题考查死亡专率的计算。本题所考查的男性结核病死亡率，是关于性别的死亡专率，题中男性结核病的死亡专率＝男性结核病死亡人数/男性同期平均人口数。由于本题中没有男性的总人口资料，因此无法计算（E对ABCD错）。